甲状舌导管于胚胎第几周时开始退化，消失
A. 胚胎第4周
B. 胚胎第5周
C. 胚胎第6周
D. 胚胎第7周
E. 胚胎第8周

正确答案：C。胚胎第6周

解析：甲状舌导管于胚胎第6周时开始退化，消失。掌握“甲状舌管囊肿”知识点。